个体生长关键期的正确描述是
A. 在该时期细胞的生长方式是以增生增大为主
B. 在该时期细胞生长主要表现为分化
C. 若在此时期受到干扰，会造成器官或组织永久性的缺陷或功能障碍
D. 若在此时期受到干扰，一般不会造成器官或组织水久性的缺陷或功能障碍
E. 各组织器官的生长关键期是相同的

正确答案：C。若在此时期受到干扰，会造成器官或组织永久性的缺陷或功能障碍

解析：本题考查生长发育的总规律。器官和功能的发育都有决定性的时期（生长关键期），每一年龄阶段都有其生长关键期，如该期的正常发育受到干扰，一旦过了生长关键期，常可残存为永久性缺陷或功能障碍（C对ABDE错）。